妇科十味片具有养血舒肝、调经止痛的功能。处方组成：醋香附500g、川芎20g、当归180g、醋延胡索40g、白术29g、甘草14g、大枣100g、白芍15g、赤芍15g、熟地黄60g、碳酸钙65g。以上十一味，当归126g、醋香附、醋延胡索、白芍、赤芍、碳酸钙粉碎成细粉，甘草、大枣加水煎煮三次，合并煎液，滤过；剩余当归与白术、熟地黄、川芎用70%乙醇加热回流二次，滤过，合并二次滤液，回收乙醇。将以上两种滤液合并，减压浓缩为稠膏，加入上述醋香附等六味细粉，混匀，干燥，粉碎成细粉，用糖浆与淀粉糊制成颗粒，干燥压制成3000片，包薄膜衣，即得。处方中碳酸钙在片剂中可用作
A. 助流剂
B. 填充剂
C. 黏合剂
D. 崩解剂
E. 润滑剂

正确答案：B。填充剂

解析：本题考查片剂辅料的种类与应用。处方中碳酸钙的主要作用填充剂（B对）。片剂制备时常加用适宜的辅料，其目的在于确保压片物料的流动性、润滑性、可压性及其成品的崩解性等。辅料品种或用量选用不当，不但可能影响制片过程，而且对片剂的质量、稳定性及其疗效的发挥均有一定甚至重要影响。片剂辅料必须具有较好的物理和化学稳定性，能与主药及其他辅料相互配伍，不影响主药的溶出、吸收和含量测定，对人体无害，且价廉易得。按用途不同，片剂辅料可分为稀释剂与吸收剂、湿润剂与黏合剂、崩解剂和润滑剂。稀释剂与吸收剂统称为填充剂。前者适用于主药剂量小于0.1g，或浸膏黏性太大，或含浸膏量多而制片困难者；后者适用于原料药（含中间体）中含有较多挥发油、脂肪油或其他液体，而需制片者。微粉硅胶、氧化镁、碳酸钙、碳酸镁等均可作为吸收剂，尤适于含挥发油和脂肪油较多的中药制片。其用量应视药料中含油量而定，一般为10%左右。其中微粉硅胶制成的颗粒有很好的流动性和可压性，也可用于粉末直接压片的助流剂（A错）和崩解剂。润湿剂与黏合剂（C错）：润湿剂与黏合剂在制片中具有使固体粉末黏结成型的作用。本身无黏性，但能润湿并诱发药粉黏性的液体，称为润湿剂。适用于具有一定黏性的药料制粒压片。本身具有黏性，能增加药粉间的黏合作用，以利于制粒和压片的辅料，称为黏合剂。适用于没有黏性或黏性不足的药料制粒压片。黏合剂有固体和液体两种类型，一般液体黏合剂的黏性较大，固体黏合剂（也称“干燥黏合剂”）往往兼有稀释剂作用。润湿剂和黏合剂品种及其用量的正确选用十分重要，不仅关系到片剂的成型过程，而且影响到片剂中有效成分的溶出及其疗效。崩解剂（D错）：系指能促使片剂在胃肠液中迅速崩解成小粒子而更利于药物溶出的辅料。崩解剂的主要作用是消除因黏合剂和高度压缩而产生的结合力。除口含片、舌下片、缓释片、咀嚼片等，一般片剂均需加用崩解剂。中药半浸膏片因含有中药饮片细粉，其本身遇水后能缓缓崩解，故一般可不另加崩解剂。润滑剂（E错）：压片前必须加入的，能增加颗粒（或粉末）流动性，减少颗粒（或粉末）与冲模内摩擦力，具有润滑作用的物料称为润滑剂。润滑剂的作用主要有：①降低压片颗粒（或粉粒）间的摩擦力，增加颗粒（或粉粒）的流动性，利于准确加料，减少片重差异。②避免粉粒在冲模表面黏附，确保片面光洁。③降低粉粒或片剂与冲模间的摩擦力，利于正常压片和出片，同时减少冲模磨损。